细菌性心内膜炎亚急性者最常见的病原菌是
A. 溶血性链球菌
B. 草绿色链球菌
C. 肠球菌
D. 金黄色葡萄球菌
E. 白色葡萄球菌

正确答案：B。草绿色链球菌

解析：本题考查自体瓣膜感染性心内膜炎。链球菌和葡萄球菌是引起感染性心内膜炎的主要病原微生物。急性者主要有金黄色葡萄球菌引起，亚急性者，草绿色链球菌（B对）最常见。